既能祛风湿，又能温经止痛的药物是
A. 独活
B. 秦艽
C. 防己
D. 狗脊
E. 川乌

正确答案：E。川乌

解析：该题考查川乌的功效。川乌味辛、苦，性热，有大毒，入心、肝、肾、脾经，其功效为祛风湿，温经止痛（E对）。